男孩，3岁，水肿一周。尿中有泡沫，尿量减少。查体：T36.7℃，P120次/分，BP90/60mmHg。眼睑水肿，双下肢凹陷性水肿，双肺呼吸音粗，未闻及啰音，心前区未闻及杂音，腹膨隆，移动性浊音（＋）。尿常规：尿蛋白（+++）。尿沉渣镜检：RBC0～3/HP，WBC0～3/HP。血清白蛋白20g/L，胆固醇8.7mmol/L。患儿在治疗中出现发热，最常见的原因是
A. 腹膜炎
B. 皮肤丹毒
C. 呼吸道感染
D. 尿路感染
E. 胃肠炎

正确答案：C。呼吸道感染

解析：男性幼儿患者，尿蛋白（+++）（提示＞3.5g/d），血清白蛋白20g/L（＜30g/L），水肿一周。综合患者的症状、体征和辅助检查，初步诊断为肾病综合征，患儿在治疗中出现发热，最常见的原因是呼吸道感染（C对），占50％以上。腹膜炎（A错）、皮肤丹毒（B错）、尿路感染（D错）、胃肠炎（E错）也是肾病综合征的并发症，但不是致发热的最常见的原因。